军团菌在自然界中普遍存在，其中检出率最高的水环境是
A. 河水
B. 溪水
C. 空调冷却塔水
D. 二次供水水箱
E. 自来水

正确答案：C。空调冷却塔水

解析：本题考查军团菌检出率最高的水环境。军团菌广泛存在于天然水体及人工水环境中，且能在其中生长、繁殖。目前，集中空调系统、淋浴设施、游泳池及喷泉等人工水环境中军团菌污染比较普遍，均可以检出军团菌，其中空调系统冷却塔水（C对ABDE错）中检出率最高，阳性率可达到50%左右。